桡骨头半脱位易发生的年龄是
A. 26～30岁
B. 21～25岁
C. 16～20岁
D. 10～15岁
E. 5岁以下

正确答案：E。5岁以下

解析：由于五岁以下的儿童桡骨头发育尚不完全，环状韧带薄弱，故桡骨头半脱位易发生的年龄是五岁以下（E对）。26～30岁（A错）、21～25岁（B错）、16～20岁（C错）、10～15岁（D错）时的桡骨头多发育完全，相对不易发生桡骨头半脱位。